脑疝最有效易行的处理原则
A. 快速静脉输注脱水剂
B. 腰椎穿刺大量引流脑脊液
C. 急性控制性过度换气
D. 施行人工冬眠物理降温
E. 将病员置于高压氧舱内

正确答案：A。快速静脉输注脱水剂

解析：脑疝最有效易行的处理原则是快速静脉输注脱水剂（A对），甘露醇等脱水剂可迅速带走体内大量的水分，降低颅内压，缓解脑疝的症状，为下一步治疗争取时间。脑疝患者严禁腰椎穿刺大量引流脑脊液（B错），否则会加重病情。急性控制性过度换气（C错）可降低血液内CO₂的张力，降低脑血流量，从而降低颅内压；施行人工冬眠物理降温（D错）可降低脑新陈代谢率，减少脑组织的氧耗量，防止脑水肿的发生与发展，可一定程度上降低颅内压；高压氧治疗（E错）可以增加血氧含量，提高血浆内氧浓度，降低颅内压，上述三种方法均可以降低颅内压，但疗效均不及快速静脉输注脱水剂。